既峻下冷积，又逐水退肿的药是
A. 甘遂
B. 商陆
C. 巴豆
D. 郁李仁
E. 牵牛子

正确答案：C。巴豆

解析：本题考查的是巴豆的性能特点。既峻下冷积，又逐水退肿的药是巴豆（C对）。巴豆：【性能特点】本品辛热泻散，大毒峻猛。内服入胃经与大肠经，善峻下寒积、逐水退肿；入肺经，善祛痰利咽而治白喉，有斩关夺门之功。外用腐蚀力强而善蚀肉腐疮，喷撒于咽部而能除白喉伪膜，敷于恶疮而能溃脓、去腐肉。生用力猛，虽峻下寒积，但因毒大，故临床几乎不用；熟用毒稍缓而药力强，临床少用；去油制霜即巴豆霜，药力较缓，毒性大减，故临床常用。甘遂（A错）：【性能特点】本品苦寒清泄沉降，毒大力强，入肺、肾、大肠经。既通利二便而泻水逐饮，又攻毒、消肿、散结，为治水肿、风痰癫痫及疮毒之猛药。“能行经隧之水湿”，服后常引起峻泻，使体内水饮得以排出。凡身面浮肿、大腹水肿及胸胁停饮正气未衰者皆可酌用，尤宜大腹水肿。生用力峻猛而毒大，醋制则泻下力与毒性均减。有效成分不溶于水，研末服泻水力佳。郁李仁（D错）：【性能特点】本品辛散苦降，甘平质润，入脾与大肠、小肠经。既润肠通便，又利水消肿，还行肠中滞气。治肠燥便秘，兼气滞者尤佳；治水肿胀满及脚气浮肿，兼二便不利者最宜。牵牛子（E错）：【性能特点】本品苦寒降泄，有毒力猛，入肺、肾、大肠经，既善通利二便，显泻下逐水与消痰涤饮之效，为治水肿、痰饮、便秘之猛药。又善消食积、驱杀肠道寄生虫，为治食积、虫积之良药。少则动大便，多则下水饮，尤宜水肿、痰饮兼二便不利或积滞内停者。功似遂、戟、芫，虽泻下逐水，使水邪从二便出，但药力与毒性均稍缓。传统认为，皮有收涩之性，故泻下逐水宜去皮用。商陆（B错）的性能特点，2022年考试指南未明确说明。